关于脂/水分配系数，下列说法正确的是
A. 在同系化合物中，对于在水中溶解度越大的化合物，由于其较易随尿排出体外，故毒性越小
B. 化学物的脂/水分配系数越大，则越容易以简单扩散的方式通过细胞膜。
C. 解离的无极性化合物脂/水分配系数较非解离化合物的大
D. 脂溶性物质易在脂肪蓄积，故肥胖者对脂溶性毒物的耐受性总是较强的

正确答案：B。化学物的脂/水分配系数越大，则越容易以简单扩散的方式通过细胞膜。

解析：本题考查脂/水分配系数。脂/水分配系数是化学物在脂相（油相）和水相中的溶解分配率达到动态平衡时的浓度之比。化学物的脂/水分配系数越大，则越容易以简单扩散的方式通过细胞膜（B对ACD错）。